休克的根本病因是
A. 血压下降
B. 中心静脉压下降
C. 心排出量下降
D. 有效循环血量下降
E. 微循环障碍

正确答案：D。有效循环血量下降

解析：引起休克的病因很多，但各类休克都有一个共同的特点，即有效循环血量急剧减少（D对）。